“纯阳”学说是指小儿
A. 发育迅速
B. 脏腑娇嫩
C. 有阳无阴
D. 阳亢阴亏
E. 形气未充

正确答案：A。发育迅速

解析：小儿“纯阳”的“纯”是指小儿先天所禀赋的元阴元阳未曾耗散，“阳”指小儿的生命活力，犹如旭日之初生，草木之方萌，蒸蒸日上，欣欣向荣，故“纯阳”指的是小儿发育迅速（A对）。脏腑娇嫩是指小儿脏腑形气皆不足，尤以肺脾肾三脏不足突出（B错）。小儿体内有元阴与元阳，不可能有阳无阴（C错）。阳亢阴亏是一种病理状态，明显错误（D错）。小儿形气未充指小儿五脏六腑功能状况不稳、未臻完善（E错）。